属于胸腺非依赖性抗原的是
A. 血清白蛋白
B. 卡介苗
C. 脂多糖
D. 类毒素
E. 抗病毒血清

正确答案：C。脂多糖

解析：物制品的制备：供防治用的疫苗、类毒素、抗毒素、免疫血清及供诊断用的菌液、抗血清等均来自培养的细菌或其代谢产物（AE错）。活疫苗亦称减毒活疫苗,是通过自然筛选或人工方法获得的病原微生物的弱毒或无毒株经培养后制备而成，比如卡介苗（B错）。类毒素是经0.3%~0.4%甲醛处理后失去了毒性但仍保持免疫原性的外毒素制成的生物制品（D错）。